下列疾病中最易发生向心性心肌肥大的疾病是：
A. 甲亢
B. 严重贫血
C. 维生素B1缺乏症
D. 高血压病
E. 主动脉瓣关闭不全

正确答案：D。高血压病

解析：高血压病（D对）时，体循环阻力增加，左心室射血时克服的阻力即后负荷增加，久之收缩期室壁张力持续增加，心肌肌节呈并联性增生，心肌细胞增粗，发生向心性心肌肥大。甲亢（A错）、严重贫血（B错）、维生素B1缺乏症（C错）、主动脉瓣关闭不全（E错）时，舒张末期心室充盈压即前负荷增加，久之舒张期室壁张力持续增加，心肌肌节呈串联性增生，心肌细胞增长，心腔容积增大，心腔容积增大又可刺激肌节并联性增生，最终发生离心性肥大。